男，38岁。因反复左侧头痛半年，加重伴呕吐3天于急诊留观。查体：浅昏迷，双侧瞳孔为左侧3mm，右侧2mm，对光反应迟钝。右侧肢体肌力4级，右侧Babinski征阳性。最可能的诊断是
A. 脑梗死
B. 颅内血肿
C. 颅脑肿瘤
D. 蛛网膜下腔出血
E. 脑膜脑炎

正确答案：C。颅脑肿瘤

解析：颅脑肿瘤起病隐匿，病程较慢，当肿瘤体积超过颅内压调节代偿能力时，会出现头痛、呕吐和视乳头水肿等颅内压增高表现，进一步发展可导致脑组织因颅内压力差而发生移位，从而出现小脑幕裂孔疝，临床表现为患侧动眼神经麻痹以及对侧锥体束损害体征。患者中年男性，反复左侧头痛半年，加重伴呕吐3天，查体：浅昏迷，双侧瞳孔为左侧3mm，右侧2mm，对光反应迟钝（瞳孔大小正常值2-5mm，双侧瞳孔不等大，左侧动眼神经麻痹），右侧肢体肌力4级，右侧Babinski征阳性（左侧锥体束受损）。应考虑慢性颅内压增高导致的小脑幕裂孔疝。慢性颅内压常见病因有颅内肿瘤、炎症及出血后黏连，该患者无颅内炎症及脑出血史，考虑颅脑肿瘤（C对）可能性大。脑梗死（A错）、蛛网膜下腔出血（D错）起病急，病程高峰数小时内即可出现。颅内血肿（B错）会有外伤史。脑膜脑炎（E错）会有病毒、细菌等感染史。